人参配莱菔子在药物七情配伍关系中属于
A. 相使
B. 相畏
C. 相杀
D. 相反
E. 相恶

正确答案：E。相恶

解析：相恶即两种药物合用，一种药物能使另一药物原有功效降低，甚至丧失。人参配莱菔子，人参补气，莱菔子降气，两药配合会降低功效，所以配伍关系是相恶（E对）。相使（A错），即将性能功效方面有某些共性，或性能功效虽不相同，但是治疗目的一致的药物配合应用，其中以一种药物为主，另一种药物为辅，两药合用，辅药能提高主药的功效。相畏（B错）就是一种药物的毒性或副作用能被另一种药物降低或消除。相杀（C错）指一种药物能够降低或消除另一种药物的毒性或副作用。相反（D错）就是两种药物同用能产生或增强毒性或副作用。